慢性唾液腺炎以哪种疾病多见
A. 慢性化脓性唾液腺炎
B. 慢性复发性腮腺炎
C. 慢性硬化性下颌下腺炎
D. 流行性腮腺炎
E. 舍格伦综合征

正确答案：A。慢性化脓性唾液腺炎

解析：慢性唾液腺炎以慢性化脓性唾液腺炎多见。掌握“慢性唾液腺炎的病理变化”知识点。